标签必须印有规定标志的药品为
A. 保健品
B. 特殊管理的药品及外用药
C. 假药
D. 劣药
E. 新药

正确答案：B。特殊管理的药品及外用药

解析：本题考查药品说明书和标签的标识管理。标签必须印有规定标志的药品为特殊管理的药品及外用药（B对）。麻醉药品、精神药品、医疗用毒性药品、放射性药品、外用药品和非处方药的标签、说明书，应当印有规定的标志。特殊管理药品是指《药品管理法》第35条规定的药品，即国家对麻醉药品、精神药品、医疗用毒性药品、放射性药品实行特殊管理。